面部各突起联合完毕在
A. 胚胎第3周
B. 胚胎第4周
C. 胚胎第5周
D. 胚胎第6周
E. 胚胎第8周

正确答案：E。胚胎第8周

解析：至第8周面部各突起联合完毕。掌握“面部的发育”知识点。